男，18岁。双下肢及颜面水肿1周。尿沉渣镜检：RBC0～2/HP，尿蛋白定量12.2g/d。血Alb18g/L，Scr79umol/L，ANA（-），乙型肝炎病毒标志物均（-）。该患者最可能的肾脏病理类型是
A. 毛细血管内增生性肾小球肾炎
B. 微小病变型肾病
C. 膜性肾病
D. 膜增生性肾小球肾炎
E. 局灶节段性肾小球硬化

正确答案：B。微小病变型肾病

解析：青少年男性患者，病程1周，出现双下肢及颜面水肿，（尿蛋白定量12.2g/d，尿蛋白定量＞3.5g/d即为大量蛋白尿），低白蛋白血症（血白蛋白18g/L，血白蛋白＜30/L即为低白蛋白血症），余检查未见异常。综合患者临床表现及实验室检查，可诊断为肾病综合征。ANA（-）（可排除狼疮肾炎可能），乙型肝炎病毒标志物均（-）（可排除乙肝相关性肾炎可能）。青少年男性肾病综合征患者，未发现继发性肾病综合征可能，因此原发性肾病综合征可能性大，青少年原发性肾综常见病理类型包括：系膜增生性肾小球肾炎、微小病变型肾病、局灶性节段性肾小球硬化及系膜毛细血管性肾小球肾炎。因此最可能的肾脏病理类型是微小病变型肾病（B对）。毛细血管内增生性肾小球肾炎（A错）表现为急性肾炎综合征，不表现为肾病综合症。膜性肾病（C错）好发于老年人。膜增生性肾小球肾炎（D错）也称为系膜毛细血管性肾小球肾炎，该型表现为肾病综合征的患者几乎均伴有血尿，该患者无血尿，因此该型可能性较小。局灶节段性肾小球硬化（E错），约3/4患者伴有血尿，确诊约半数患者有高血压，约30%有肾功能减退，因此该型可能性较小。